可能引起驾驶员视力模糊或辨色困难的药物是
A. 布洛芬
B. 吲哚美辛
C. 硝酸甘油
D. 卡马西平
E. 二氢麦角碱

正确答案：A、B、C、D、E。布洛芬；吲哚美辛；硝酸甘油；卡马西平；二氢麦角碱

解析：本题考查特殊人群用药。可能引起驾驶员视力模糊或变色困难的药物是布洛芬（A对）、吲哚美辛（B对）、硝酸甘油（C对）、卡马西平（D对）、二氢麦角碱（E对）。布洛芬服用后会出现视力下降、辨色困难等不良反应。吲哚美辛服用后可出现视力模糊、耳鸣、复视等不良反应。硝酸甘油服用后会出现视力模糊的症状。卡马西平可引起视力模糊、复视或眩晕。二氢麦角碱服用后会使视力模糊而看不清路况。